有关（牙合）力与牙周组织关系的描述中，说法错误的是
A. 最大（牙合）力有性别差异
B. 最大（牙合）力有年龄差异
C. 最大（牙合）力可经过锻炼而增强
D. 沿水平方向的（牙合）力有利于牙周组织
E. 沿牙体长轴方向的（牙合）力有利于牙周组织

正确答案：D。沿水平方向的（牙合）力有利于牙周组织

解析：最大（牙合）力：为牙周组织所能耐受的最大力。影响（牙合）力的因素主要有性别、年龄、咀嚼习惯、（牙合）力线的方向、张口距离以及口颌系统的状态等（牙合）力为生物力，各种（牙合）力测量仪虽能测得一定（牙合）力，但与实际（牙合）力尚有差距，且不同类型的（牙合）力仪，其测量值也有差异。牙周的纤维在垂直方向上的承受力最好，水平力很容易对其造成伤害。掌握“咀嚼过程、类型，咀嚼周期及生物力”知识点。